前牙3/4冠邻面预备时下面错误的是
A. 近远中面平行
B. 与长轴平行
C. 唇侧边界止于接触区
D. 在唇舌向与邻面外形一致
E. 两邻面向长轴稍聚合2°～5°

正确答案：C。唇侧边界止于接触区

解析：本题考查前牙3/4冠的邻面预备。邻面预备的目的是为3/4冠预备出足够的邻面间隙，消除覆盖区的倒凹，保证冠顺利就位。邻面预备时用针状细长车针从舌隆突下轴壁的邻舌线角处向唇面切割，唇侧边界止于自洁区，若止于接触区（C错，为本题的正确答案）易导致菌斑形成，发生龋病。去除倒凹，近远中面平行（A对）。前牙3/4冠邻面预备时，要求两邻面在切龈方向上，即牙长轴方向相互平行（B对）或在切端方向稍聚合2°～5°（E对），在唇舌向与邻面外形一致（D对），以利于就位。